为增加黏结力，黏结之前预备体表面需作处理，除了
A. 涂分离剂
B. 干燥
C. 酸蚀
D. 清洁
E. 去油污

正确答案：A。涂分离剂

解析：本题目主要考查修复体试戴、磨光与粘固。为增加黏结力，黏结之前预备体表面需作处理，除了涂分离剂（A错，为本题正确答案）。分离剂：在两种相同的或不同的材料之间、材料与模具之间隔离膜，使二者间不发生粘连，完成操作后易于分离的液剂。